在周围神经系内，神经元胞体聚集的结构称
A. 纤维束
B. 白质
C. 神经核
D. 神经节
E. 无

正确答案：D。神经节

解析：在周围神经系内，神经元胞体聚集的结构称神经节（D对）。在中枢神经系统内，起止、行程和功能相同的神经纤维集聚并走行在一起称纤维束（A错）；白质（B错）由各种不同功能的神经纤维在中枢神经系统内聚集而成；在中枢神经系统内，形态和功能相似的神经元胞体及其树突聚集在一起形成的灰质团块，称为神经核（C错）。